下列关于“单侧完全性腭裂”的叙述，不恰当的是
A. 单侧完全性腭裂的裂隙自腭垂至切牙孔完全裂开
B. 裂隙斜向外侧直抵牙槽突
C. 裂隙与牙槽裂相连
D. 健侧裂隙缘与鼻中隔相连
E. 不会伴发同侧唇裂

正确答案：E。不会伴发同侧唇裂

解析：单侧完全性腭裂：单侧完全性腭裂的裂隙自腭垂至切牙孔完全裂开，并斜向外侧直抵牙槽突，与牙槽裂相连；健侧裂隙缘与鼻中隔相连；牙槽突裂有时裂隙消失仅存裂缝，有时裂隙很宽；常伴发同侧唇裂。掌握“腭裂”知识点。